男，45岁。右眼睑下垂伴复视2个月。既往有蛛网膜下腔出血病史。查体右眼球外斜位，右侧瞳孔散大，对光反射消失。增强CT检查显示鞍旁右侧有一直径约0.5cm圆形高密度影，其周围无脑水肿征。首先考虑的诊断是
A. 鞍旁脑膜瘤
B. 颈内动脉、后交通动脉瘤
C. 三叉神经鞘瘤
D. 颞叶胶质瘤
E. 颞叶脑脓肿

正确答案：B。颈内动脉、后交通动脉瘤

解析：患者中年男性，既往有蛛网膜下腔出血病史，提示颅内动脉瘤存在可能性大，出现右眼睑下垂伴复视2个月、查体右眼球外斜位、右侧瞳孔散大、对光反射消失等动眼神经麻痹表现提示动眼神经受压或病损，增强CT检查显示鞍旁右侧有一直径约0.5cm圆形高密度影，周围无脑水肿征提示该高密度影非脑出血引起，而是动脉瘤所致。综上，考虑诊断为右侧颈内动脉后交通动脉瘤（B对）。鞍旁脑膜瘤（A错）、三叉神经鞘瘤（C错）、颞叶胶质瘤（D错）和颞叶脑脓肿（E错）均非颅内血管瘤，不会出现增强CT下高密度影，且临床表现不同于题中所述。